下颌下淋巴结
A. 位于下颌角附近
B. 收集头颈部的淋巴
C. 输出管组成颈干
D. 口腔炎症常引起该群淋巴结肿大
E. 当其病变时，体表不可触及

正确答案：D。口腔炎症常引起该群淋巴结肿大

解析：下颌下淋巴结引流面部和口腔器官的淋巴（AB错），当口腔内出现炎症时，下颌下淋巴结即可出现肿大（D错）。